基于病变组织与正常组织间酸碱性差异的靶向制剂是
A. 常规脂质体
B. 微球
C. 纳米囊
D. pH敏感脂质体
E. 免疫脂质体

正确答案：D。pH敏感脂质体

解析：本题考查靶向制剂。利用肿瘤间质液的pH比周围正常组织显著低的特点，设计了pH敏感型脂质体（D对）。这种脂质体在低pH范围内可释放药物，通常采用对pH敏感的类脂（如DPPC、十七烷酸磷脂）为类脂质膜。其原理是pH降低时，可导致脂肪酸羧基的质子化形成六方晶相的非相层结构而使膜融合加速释药。常规脂质体（A错）系一类由胆固醇和磷脂组成，含有脂质双层包围水相的内囊泡结构的脂质体，不具有主动靶向作用。微球（B错）和纳米囊（C错）为被动靶向制剂。免疫脂质体（E错）为主动靶向制剂。